有感染高危因素的医院获得性肺炎，病原体排在首位的是
A. 肠杆菌科细菌
B. 肺炎链球菌
C. 铜绿假单胞菌
D. 军团菌
E. 金黄色葡萄球菌

正确答案：E。金黄色葡萄球菌

解析：最常见的医院内肺炎即医院获得性肺炎的致病菌分两种情况，第一种，无感染高危因素，最常见的致病菌为肺炎链球菌，其他依次为流感嗜血杆菌、金黄色葡萄球菌、大肠杆菌、肺炎克雷伯杆菌。第二种，有感染高危因素的患者，此时最常见的致病菌为金黄色葡萄球菌，其他依次为铜绿假单胞菌、肠杆菌属、肺炎克雷伯杆菌。